医疗机构实施手术、特殊检查或者特殊治疗时，如果无法取得患者意见又无家属或关系人在场时，应当
A. 经治医师提出医疗处置方案，在取得医疗机构负责人或者被授权负责人的批准后实施
B. 经治医师提出医疗处置方案，在取得群众认可后实施
C. 经治医师提出医疗处置方案，在取得第三人证实后实施
D. 经治医师提出医疗处置方案，在取得县级以上卫生行政部门批准后实施
E. 经治医师提出医疗处置方案，在取得同行讨论后批准实施

正确答案：A。经治医师提出医疗处置方案，在取得医疗机构负责人或者被授权负责人的批准后实施

解析：施行手术、特殊检查或者特殊治疗时，必须征得患者同意，并应当取得其家属或者关系人同意并签字；无法取得患者意见时，应当取得家属或者关系人同意并签字；无法取得患者意见又无家属或者关系人在场，或者遇到其他特殊情况时，经治医师应当提出医疗处置方案，在取得医疗机构负责人或者被授权负责人员的批准后实施。掌握“医疗机构概述及机构执业”知识点。